设计隙卡制备牙体时，不能预备成楔形，也不能破坏两相邻牙的接触点，这样做的原因是
A. 尽量利用天然间隙
B. 防止基牙间食物嵌塞
C. 尽量少磨除牙体组织
D. 防止基牙龋坏
E. 避免形成楔力使基牙移位

正确答案：E。避免形成楔力使基牙移位

解析：本题考查隙卡沟的预备。设计隙卡制备牙体时，不能预备成楔形，也不能破坏两相邻牙的接触点，这样做的原因是避免形成楔力使基牙移位（E对）。若预备成楔形或破坏两相邻牙的接触点，在咬合时，会在两邻牙间产生一个楔力，使基牙移位，不利于基牙及邻牙健康。尽量利用天然间隙（A错）是为了尽量少磨除牙体组织（C错），防止基牙龋坏（D错）是牙体修复的原则之一，都与不能预备成楔形，也不能破坏两相邻牙的接触点无关。防止基牙间食物嵌塞（B错）也是隙卡的一个作用，关键在于与两牙密合，与隙卡的外形无关。